不会对病人造成伤害的医务人员的行为是
A. 知识和技能低下
B. 行为疏忽和粗枝大叶
C. 强迫病人接受检查和治疗
D. 对病人呼叫或提问置之不理
E. 为治疗疾病适当地限制或约束病人的自由

正确答案：E。为治疗疾病适当地限制或约束病人的自由